急性肾小球肾炎的发病机制是
A. 溶血性链球菌感染后的炎症反应
B. 溶血性链球菌感染后的免疫反应
C. 细菌直接感染肾脏
D. 病毒直接破坏肾脏
E. 溶血性链球菌感染所致的中毒反应

正确答案：B。溶血性链球菌感染后的免疫反应

解析：一般认为，溶血性链球菌感染后的免疫机制（B对）是肾小球病的始发机制，在此基础上炎症介质（如补体、细胞因子、活性氧等）参与，最后导致肾小球损伤产生临床症状。溶血性链球菌感染后的炎症反应（A错）、细菌直接感染肾脏（C错）、病毒直接破坏肾脏（D错）、溶血性链球菌感染所致的中毒反应（E错）均不是其发病机制。